患者，男，78岁，因心房颤动服用华法林治疗2年余。后因真菌感染使用氟康唑，用药后INR升高并出现咳血症状。出现该症状的主要原因是
A. 氟康唑抑制华法林的肾脏排泄导致华法林血药浓度升高
B. 氟康唑具有较强的血浆蛋白结合力，导致血中游离的华法林浓度升高
C. 氟康唑可增加华法林的吸收，导致华法林血药浓度升高
D. 氟康唑可抑制CYP2C9，导致华法林血药浓度升高
E. 氟康唑可抑制CYP3A4，导致华法林血药浓度升高

正确答案：D。氟康唑可抑制CYP2C9，导致华法林血药浓度升高

解析：本题考查氟康唑。患者出现题干所述症状的主要原因是：氟康唑可抑制CYP2C9，导致华法林血药浓度升高（D对）。氟康唑属于CYP2C9肝药酶抑制剂，可抑制CYP2C9，导致华法林血药浓度升高，故患者使用氟康唑后INR升高并出现咳血症状。